依据《传染病防治法》的规定，各级各类医疗保健机构在传染病防治方面的职责是
A. 对传染病防治工作实施统一监督管理
B. 按照专业分工承担责任范围内的传染病监测管理工作
C. 承担责任范围内的传染病防治工作
D. 领导所辖区域传染病防治工作
E. 设立专人负责各施工区域的卫生防疫工作

正确答案：C。承担责任范围内的传染病防治工作